冬季建筑施工加入的防冻剂，会造成建筑物渗出
A. HCHO
B. NH₃
C. NO₂
D. SO₂
E. ²²²Rn

正确答案：B。NH₃

解析：本题考查冬季建筑施工加入的防冻剂，会造成建筑物渗出的气体。建筑物自身会含有某些可逸出挥发的有害物质，当冬季建筑施工加入防冻剂，会造成建筑物渗出有毒气体氨（B对ACDE错）。